患者，女，30岁。反复上腹痛6年，饥饿时加重，进食后减轻。近1周来进食后上腹部胀痛加重，但大量呕吐后减轻。查体：轻度脱水，上腹部膨隆，有震水音。应首先考虑的是：
A. 多发性溃疡病
B. 复合性溃疡病
C. 胃溃疡恶变
D. 十二指肠溃疡伴幽门梗阻
E. 胃窦部溃疡伴急性穿孔

正确答案：D。十二指肠溃疡伴幽门梗阻

解析：本例患者为青年女性，有反复上腹痛，饥饿时加重，进餐后减轻的病史，符合十二指肠溃疡特点，近期于进食后出现腹痛、腹胀加重，呕吐后腹痛稍有缓解，查体发现有轻度脱水，上腹膨隆，有震水音，说明存在幽门梗阻，故诊断首先考虑的是十二指肠溃疡伴幽门梗阻（D对）。多发性溃疡病（A错）是在一个部位有多个溃疡发生，主要表现为腹痛；复合性溃疡病（P370）（B错）指胃和十二指肠均有活动性溃疡，多见于男性，主要表现为腹痛；胃溃疡恶变（C错）主要表现为上腹痛、餐后加重、纳差、乏力，查体早期多无明显体征，进展期在上腹部可扪及肿块，有压痛；胃窦部溃疡伴急性穿孔（E错）主要表现为突发剧烈腹痛，持续而加剧，查体可见腹膜刺激征阳性，肝浊音界消失，部分患者可出现休克，这四种情况一般不会出现呕吐后腹痛减轻和震水音。